患者，女，实验室检查：血红蛋白95g/L，临床诊断为缺铁性贫血，处方口服硫酸亚铁片。下列向患者交代的用药注意事项，错误的是
A. 不宜与钙剂同时服用
B. 宜空腹服用
C. 宜同时补充维生素C
D. 不宜同时进食牛奶和蛋类
E. 避免应用抑酸药

正确答案：B。宜空腹服用

解析：本题考查铁剂的使用。硫酸亚铁具有胃肠反应，常使患者不能耐受，因此建议在餐后服用（B错，为本题正确答案）。牛奶、蛋类中含钙，可抑制铁剂吸收（D对），故硫酸亚铁不宜与钙剂同时服用（A对）。维生素C可促进铁剂吸收，故服用硫酸亚铁的同时宜补充维生素C（C对）。铁剂必须是二价铁才被机体吸收，而抑酸药物会影响三价铁转化为二价铁，所以应避免应用抑酸药（E对）。